VLDL主要功能
A. 运送内源性TG
B. 运送内源性Ch
C. 运送外源性TG
D. 蛋白质含量最高
E. 与冠状动脉粥样硬化的发生率呈负相关

正确答案：A。运送内源性TG

解析：极低密度脂蛋白（VLDL）的主要功能是运输肝脏中合成的内源性甘油三酯（TG）。掌握“甘油磷脂、胆固醇和血脂蛋白代谢”知识点。